女，56岁。右乳头间断血性溢液1年，触及肿物6个月，无疼痛不适。查体：T36.5℃.P80次／分，BP120/80mmHg，腋窝可触及成团融合并固定的淋巴结。心肺腹查体未见异常。右乳头轻度内陷，按压乳晕周围可见右乳头单孔少量血性溢液，右乳乳晕深面可及5.5cm×4cm包块，质硬，边界不清，与胸壁粘连固定。下一步首选的治疗是
A. 术前化疗
B. 右乳单纯乳房切除术
C. 术前放疗
D. 右乳腺癌改良根治术
E. 右乳保留乳房乳腺癌切除术

正确答案：A。术前化疗

解析：患者为56岁女性，右乳头间断血性溢液1年，触及无痛性肿块6个月，查体可见右乳轻度内陷，按压乳晕周围可见右乳头单孔少量血性溢液，右乳乳晕深面可及5.5cm×4cm包块，质硬，边界不清，活动性差，腋窝可触及成团融合并固定的淋巴结，综合该患者的临床表现，考虑为乳腺癌Ⅲ期（T₃N₂M₀，癌瘤长径＞5cm，同侧腋窝肿大淋巴结彼此融合）的可能性较大。术前化疗（A对）多用于局部晚期的病例， 全乳房切除术（B错）适宜于原位癌、微小癌及年迈体弱不宜作根治术者，九版教材尚未阐述术前放疗（C错）用于乳腺癌治疗中，乳腺癌改良根治术（D错）和保留乳房的乳腺癌切除术（E错）均适用于临床I期、II期的乳腺癌病人但前者为目前常用的手术术式。